卵泡早期分泌量少，排卵前达高峰，以后降低，排卵后期再度增高的激素是
A. 卵泡刺激素
B. 雌激素
C. 黄体生成素
D. 孕激素
E. 催乳激素

正确答案：B。雌激素

解析：卵泡早期分泌量少，排卵前达高峰，以后降低，排卵后期再度增高的激素是雌激素（B对）。卵泡刺激素（FSH）（A错）在月经周期中处于比较稳定的状态，月经期第14天左右出现一个小高峰。黄体生成素（LH）（C错）在月经周期中处于比较稳定的状态，月经期第14天左右出现一个高峰（八版生理学P427图11-6）。孕激素（D错）是在卵泡期不分泌，排卵后分泌量明显增加，8～9天后逐渐下降的激素。催乳激素（E错）的水平与妊娠有关（八版生理学P384）。